国家基本药物遴选原则，除临床必需、安全有效、价格合理、使用方便之外，还有一条是
A. 保证供应
B. 中西药并重
C. 以西药为主
D. 国产优先
E. 非进口药品

正确答案：B。中西药并重

解析：本题考查基本药物目录遴选原则。国家基本药物遴选原则，除临床必需、安全有效、价格合理、使用方便之外，还有一条是中西药并重（B对）。国家基本药物遴选应当按照防治必需、安全有效、价格合理、使用方便、中西药并重、基本保障、临床必需和基层能够配备的原则，结合我国用药特点，参照国际经验，合理确定品种（剂型）和数量。